哺乳期妇女禁用的药品是
A. 左氧氟沙星
B. 硫糖铝
C. 罗红霉素
D. 胰岛素
E. 复方氨基酸

正确答案：A。左氧氟沙星

解析：本题考查特殊人群用药。哺乳期妇女禁用的药品是左氧氟沙星（A对）。药物经乳汁排泄是哺乳期所特有的药物排泄途径，有的药物可能会通过乳汁对新生儿产生不良影响，所以部分药品哺乳期妇女禁用，如左氧氟沙星，可能会对新生儿肝脏、肾脏发育造成影响，所以哺乳期妇女禁用。硫糖铝（B错）、罗红霉素（C错）、胰岛素（D错）、复方氨基酸（E错）哺乳期妇女可用。